牙冠延长术后，涉及美容的修复应在术后何时进行
A. 术后4～6周
B. 术后6～8周
C. 术后8～12周
D. 1个月
E. 2个月

正确答案：E。2个月

解析：牙冠延长术后修复体的制作一般在术后4～6周，此时组织愈合、龈缘位置基本稳定。涉及美容的修复应至少在术后2个月后开始。如果过早修复，往往会干扰组织的正常愈合，并在组织充分愈合后导致修复体边缘的暴露。掌握“牙周健康与修复”知识点。